对于《执业医师法》的适用对象，以下说法不正确的是
A. 本法颁布之日前按照国家有关规定取得医学专业技术职称和医学专业技术职务的人员
B. 乡村医生
C. 计划生育技术服务机构中的医师
D. 军队医师
E. 在中国境内申请医师考试、注册、执业或者从事临床示教、临床研究等活动的境外人员

正确答案：E。在中国境内申请医师考试、注册、执业或者从事临床示教、临床研究等活动的境外人员